影响药物治疗有效性的因素不包括
A. 给药途径
B. 药品价格
C. 药物相互作用
D. 患者的病理生理状态
E. 给药时间

正确答案：B。药品价格

解析：本题考查影响药物治疗有效性的因素。影响药物治疗有效性的因素不包括药品价格（B错，为本题正确答案）。药物治疗的有效性是选择药物的首要标准，应考虑如下因素：（1）药物方面因素：药物的药理学特性、理化性质、剂型、给药途径（A对）、药物之间的相互作用（C对）等因素均会影响药物治疗的有效性。（2）机体方面因素：患者年龄、体重、性别、精神因素、病理状态（D对）、时间因素（E对）等对药物治疗效果均可产生重要影响。